乙肝病毒感染并肝脏功能损害的妇女不宜采取的避孕方法是
A. 避孕药
B. 阴道隔膜
C. 自然避孕
D. 输卵管绝育术
E. 避孕套

正确答案：A。避孕药

解析：本题考查常用的避孕方法。凡是药物都会给的肾脏造成负担，因为也是由肝脏的功能作用的。乙肝病毒携带者不宜采用避孕药（A错，为本题正确答案）来避孕，肝脏是人体的代谢器官，具有解毒功能。避孕药在体内发挥作用的同时，又需经过肝脏代谢，最后由肾脏排出体外。如果乙肝病毒携带者肝功能异常，使用避孕药会加重肝脏负担，促使病情恶化，还会造成肝脏中毒，从而使乙肝病毒携带者的病情加重。患肝脏疾病妇女最宜使用避孕套（E对）、自然避孕（C对）、阴道隔膜（B对）、输卵管绝育术（D对）及外用避孕药膜来避孕。